临床称为“大三阳”的乙型肝炎者血清学检查呈阳性的标志物有
A. 乙型肝炎病毒表面抗原（HBsAg）
B. 血清丙氨酸氨基转移酶（ALT）
C. 乙型肝炎病毒e抗原（HBeAg）
D. 乙型肝炎病毒e抗体（HBeAb）
E. 乙型肝炎病毒核心抗体（HBcAb）

正确答案：A、C、E。乙型肝炎病毒表面抗原（HBsAg）；乙型肝炎病毒e抗原（HBeAg）；乙型肝炎病毒核心抗体（HBcAb）

解析：本题考查乙型肝炎血清免疫学检查。在乙型肝炎患者血液中检出乙型肝炎病毒表面抗原（A对）、e抗原（C对）、核心抗体（E对）同为阳性，在临床上称为“大三阳”。